临床病证的虚实，主要取决于
A. 正气的强弱
B. 正邪的消长
C. 阴阳的盛衰
D. 气血的盛衰
E. 气机的失调

正确答案：B。正邪的消长

解析：正气有盛衰，邪气有强弱，正气能够抵抗邪气，邪气能够损害正气，在疾病演变过程中，形成了邪正盛衰消长的变化，这种变化，决定了临床病症的虚实（B对）。正气的强弱是决定发病与否的关键因素和内在根据，了正气不足，是病邪侵入和发病的内在因素（A错）。“阳胜则热，阴胜则寒”阴阳偏盛必然导致机体寒热变化，邪正盛衰是虚实病证的机理，阴阳失调是寒热病证的病机，二者在阐释疾病的发生发展及归机理时，常联合应用、互为羽翼（C错）。人体精气血的充足和运行协调，是脏腑经络、五官九窍、四肢百骸进行生理活动的物质基础。如果人体的精气血失常，必然会影响机体的各种生理功能，而导致疾病的发生，但虚实并不取决于此（D错）。气机失调，指气的升降出入失常而引起的气滞、气逆、气陷、气闭、气脱等病机变化。气的升降出入失常，则能影响脏腑经络及精气血津液等各种功能的协调平衡，病变涉及脏腑经络、形体官窍等各个方面（E错）。